某男，4岁。2天来，咳嗽，咳痰，发热，鼻塞，流涕，微恶风寒，咽红而痛，苔薄黄。证属风热袭肺。治当疏风清热，宣肺止咳，宜选用的成药是
A. 一捻金
B. 鹭鸶咯丸
C. 解肌宁嗽丸
D. 儿童清肺丸
E. 清宣止咳颗粒

正确答案：E。清宣止咳颗粒

解析：本题考查的是清宣止咳颗粒的功能。2天来，咳嗽，咳痰，发热，鼻塞，流涕，微恶风寒，咽红而痛，苔薄黄。证属风热袭肺。治当疏风清热，宣肺止咳，宜选用的成药是清宣止咳颗粒（E对）。清宣止咳颗粒：【功能】疏风清热，宣肺止咳。一捻金（A错）：【功能】消食导滞，祛痰通便。鹭鸶咯丸（B错）：【功能】宣肺，化痰，止咳。解肌宁嗽丸（C错）：【功能】解表宣肺，止咳化痰。儿童清肺丸（D错）：【功能】清肺，解表，化痰，止嗽。